组织细胞在绝对不应期时其兴奋性
A. 为零
B. 小于正常
C. 大于正常
D. 无限大
E. 正常

正确答案：A。为零

解析：可兴奋细胞在发生一次兴奋后，其兴奋性将出现一系列周期性变化，依次为绝对不应期、相对不应期、超常期、低常期、正常期。绝对不应期是指在兴奋发生的最初一段时间内，无论施加多强的刺激，也不能细胞再次兴奋的时期，其兴奋性为零（A对），细胞暂时失去兴奋性，此时兴奋阈值无限大。小于正常（B错）为相对不应期兴奋性的特点；大于正常（C错）为超常期兴奋性的特点；可兴奋细胞的兴奋性无无限大（D错）的说法；正常（E错）为正常期兴奋性的特点。